下列选项中，在病例对照研究与现况研究中均为常见的偏倚是
A. 选择偏倚
B. 排除偏倚
C. 信息偏倚
D. 混杂偏倚

正确答案：A。选择偏倚

解析：本题考查病例对照研究与现况研究中常见的偏倚。在病例对照研究与现况研究中均为常见的偏倚是选择偏倚（A对BCD错）。病例对照研究中常见的选择偏倚包括入院率偏倚、现患病例-新发病例偏倚等。